在注射剂中，用于调节渗透压的辅料是
A. 乳酸
B. 果胶
C. 甘油
D. 聚山梨酯80
E. 酒石酸

正确答案：C。甘油

解析：本题考查注射剂常用的等渗调节剂。注射剂中常用的渗透压调节剂有氯化钠、葡萄糖、甘油（C对）等。乳酸（A错）、酒石酸（E错）为注射剂中常用的缓冲剂。果胶（B错）为注射剂中常用的助悬剂。聚山梨酯80（D错）为注射剂中常用的增溶剂、润湿剂和乳化剂。